剖宫产术后3个月哺乳期妇女，最恰当的避孕方法应选择
A. 短效口服避孕药
B. 安全期避孕法
C. 宫内节育器
D. 皮下埋植法
E. 阴茎套避孕法

正确答案：E。阴茎套避孕法

解析：哺乳期妇女避孕措施的选择以不影响乳汁质量及婴儿健康为原则，最恰当的避孕方法应选择阴茎套避孕法（E对）。也可以选用皮下埋植法（D错），但其为哺乳期妇女的次选避孕方法。哺乳期不宜使用短效口服避孕药（雌、孕激素复合避孕药）（A错）或避孕针以及安全期避孕（B错）。宫内节育器（C错）应在剖宫产术后半年后放置，本例仅术后3个月，不宜选用。